男，9个月。呕吐腹泻伴体温升高（38℃）1天，腹泻12次/天，水样便，1天前误饮不洁水。查体：皮肤弹性差，精神萎靡，眼眶及前囟凹陷，体重下降6%，中毒症状明显。实验室检查：外周血白细胞总数稍增加，淋巴细胞明显增加，大便镜检无特殊发现。该患儿最有可能的诊断是
A. 细菌性痢疾
B. 肠伤寒
C. 肠结核
D. 病毒性肠炎
E. 生理性腹泻

正确答案：D。病毒性肠炎

解析：患儿腹泻，水样便，实验室检查提示淋巴细胞明显增加，提示为病毒感染引起肠炎（D对）。细菌性痢疾（A错）患者大便为黏液脓血便。肠伤寒（B错）2岁以下患者少见，且多并发肠出血。患儿无结核病史，肠结核（C错）不考虑。患儿一般状况差，中毒症状明显，排除生理性腹泻（E错）。